男，50岁，1周来右侧后牙咬物不适，冷水引起疼痛。近3日来，夜痛影响睡眠，并引起半侧头、面部痛，痛不能定位。检查时见右侧上、下第一磨牙均有咬合面龋洞。患牙的诊断最可能是
A. 深龋
B. 可复性牙髓炎
C. 急性牙髓炎
D. 慢性牙髓炎
E. 牙髓坏死

正确答案：C。急性牙髓炎

解析：本题考查急性牙髓炎的临床表现。急性牙髓炎（C对）有典型的疼痛症状，夜间痛影响睡眠，疼痛发作时患者大多不能明确指出患牙所在，且疼痛呈放射性或牵涉性，常常沿三叉神经第二支或第三支分别区域放射至患牙同侧的上、下颌牙或头、颞、面、耳等部位。深龋（A错）和可复性牙髓炎（B错）一般没有自发痛。慢性牙髓炎（D错）一般可定位患牙。牙髓坏死（E错）不能传递感觉，一般无自觉症状。